反映机体对食物蛋白质利用程度的指标是
A. 摄入氮
B. 蛋白质消化率
C. 生物价
D. 正/负氨平衡
E. 吸收氮

正确答案：C。生物价

解析：《营养与食品卫生学》第八版第29页
蛋白质生物价是反映食物蛋白质消化吸收后，被机体利用程度的指标。